下列选项中将肝脏分为大致相等的两半的解剖结构是
A. 镰状韧带
B. 右叶间裂
C. 正中裂
D. 冠状韧带
E. 左右三角韧带连线

正确答案：C。正中裂

解析：在肝的膈面，正中裂（C对）起自胆囊切迹，向后上方抵于下腔静脉左缘处，将肝脏分为大致相等的两半。镰状韧带（A错）、右叶间裂（B错）分别位于正中裂左、右侧，将肝脏分为大小不等的两半。镰状韧带向左后上方延伸并向左、右伸展形成冠状韧带，冠状韧带向左右延伸形成左、右三角韧带。肝脏呈一不规则楔形，所以冠状韧带（D错）、左右三角韧带连线（E错）将肝脏分为极不相等的两部分。